以部位命名的外科疾病是
A. 肠痈
B. 黄水疮
C. 流注
D. 子痈
E. 冻疮

正确答案：D。子痈

解析：中医外科学多是以疾病的某一特征对外科疾病加以命名。一般是依据其发病部位、穴位、脏腑、病因、形态、颜色、特征、范围、病程、传染性等来进行。如以部位命名者，有乳痈、子痈（D对）、对口疽等；以穴位命名者，有人中疔、委中毒、膻中疽等；以脏腑命名者，有肠痈（A错）、肝痈、肺痈等；以症状命名者，如红丝疔、麻风、黄水疮（B错）、瘰疬、乳头破碎等；以颜色命名者，有白驳风、丹毒等；以疾病特征命名者，有烂疔、流注（C错）、湿疮等；以病因命名者，有破伤风、冻疮（E错）、漆疮等；以形态命名者，有蛇头疔、鹅掌风等；以范围大小命名者，如小者为疖、大者为痈等；以病程长短命名者，有千日疮等；以传染性命名者，有疫疔等。